未取得职业卫生技术服务资质认证擅自从事职业卫生技术服务的，或者医疗卫生机构未经批准擅自从事职业健康检查、职业病诊断的，应承担以下法律责任，除了
A. 责令停止违法行为，没收违法所得
B. 违法所得五千元以上的，并处违法所得二倍以上十倍以下的罚款
C. 没有违法所得或者违法所得不足五千元的，并处五千元以上五万元以下罚款
D. 吊销医疗机构执业许可证
E. 情节严重的，对直接负责的主管人员和其他直接责任人员，依法给予降级，撤职或者开除处分

正确答案：D。吊销医疗机构执业许可证